患者男性，78岁，双侧腹股沟部出现圆形肿物，不降入阴囊，平卧时可消失，应诊断为
A. 腹股沟直疝
B. 腹股沟斜疝
C. 股疝
D. 难复性疝
E. 嵌顿疝

正确答案：A。腹股沟直疝

解析：腹股沟直疝常见于年老体弱者。表现为患者直立时，在腹股沟内侧端，耻骨结节上外方出现一半球形肿块，肿块较软，可无任何症状。直疝囊颈宽大，平卧后疝内容物常自行复位，站立时鼓出，鸽蛋大小。直疝绝不进入阴囊，极少发生嵌顿（A对）。腹股沟斜疝多见于儿童和青中年男性，包括易复性斜疝、难复性斜疝、嵌顿性斜疝、绞窄性斜疝，其中易复性疝为腹股沟区出现可复性肿块，站立或负重时出现，平卧休息或用手推送，肿块可回纳腹腔，如肿块不断增大则可进入阴囊或者大阴唇（B错）。股疝常在腹股沟韧带下方卵圆窝处出现一半球形肿块，一般约核桃大小，除部分病人在久站或咳嗽时感到患处胀痛外，无明显其他症状，尤其肥胖病人易被忽视（C错）。难复性斜疝除坠胀感、牵引痛稍重外，其主要表现为包块不能完全回纳，尚有消化不良和便秘等症状。滑动性斜疝也属难复性疝，多见于青壮年男性，右多于左，其比例约为6:1。虽不多见，但滑入疝囊内的盲肠或乙状结肠在疝手术时容易误当疝囊切开，应予注意（D错）。嵌顿性斜疝发生在高强度劳动或剧烈咳嗽及严重便秘等腹内压骤增时，主要表现为包块突然增大，伴有明显疼痛，包块变硬无弹性，触痛明显，不能回纳；如疝内容物为肠管，可出现腹部绞痛、恶心、呕吐、便秘、腹胀等急性肠梗阻或绞窄性肠梗阻症状；若疝内容物为大网膜，局部触痛常较轻（E错）。